某男，55岁。近期血压不稳，时有升高，伴轻度去面、下肢浮肿。证属肝阳上亢，伴有水肿，治宜平肝、利水，宜选用的药是
A. 钩藤
B. 罗布麻叶
C. 天麻
D. 菊花
E. 益母草

正确答案：B。罗布麻叶

解析：本题考查的是罗布麻叶的功效。近期血压不稳，时有升高，伴轻度去面、下肢浮肿。证属肝阳上亢，伴有水肿，治宜平肝、利水，宜选用的药是罗布麻叶（B对）。罗布麻叶：【功效】平肝清热，降血压，利水。钩藤（A错）：【功效】息风止痉，清热平肝。天麻（C错）：【功效】息风止痉，平抑肝阳，祛风通络。菊花（D错）：【功效】疏散风热，平肝明目，清热解毒。益母草（E错）：【功效】活血祛瘀，利尿消肿，清热解毒。